输尿管结石时可以导致
A. 肾后性急性肾衰竭
B. 肾前性急性肾衰竭
C. 肾性急性肾衰竭
D. 器质性肾衰竭
E. 各型肾衰竭

正确答案：A。肾后性急性肾衰竭

解析：输尿管结石时可以导致肾后性急性肾衰竭（A对）。